关于蛋白质互补作用下列说法错误的是
A. 大豆通常和玉米一起食用，可起到蛋白质互补作用
B. 适当的蛋白质按比例混合食用，可提高混合蛋白质的生物价
C. 搭配的食物种类越多，蛋白质互补作用越好
D. 各种蛋白质必须同时食用，才能发挥蛋白质互补作用
E. 谷类蛋白中的第一限制氨基酸是赖氨酸

正确答案：D。各种蛋白质必须同时食用，才能发挥蛋白质互补作用